多巴胺药理作用不包括
A. 减少肾血流量，使尿量减少
B. 对血管平滑肌β₂受体作用很弱
C. 直接激动心脏β₁受体
D. 激动血管平滑肌多巴胺能受体
E. 间接促进去甲肾上腺素释放

正确答案：A。减少肾血流量，使尿量减少